患儿，12岁，被暴打达8小时之久，其后突发少尿，神志不清。检查：血中尿素氮50mg/dl，肌酐5mg/dl，其肾脏的变化是
A. 肾梗死
B. 肾脓肿
C. 肾小管坏死
D. 快速进行性肾小球肾炎
E. 毛细血管内增生性肾小球肾炎

正确答案：C。肾小管坏死

解析：肾小管坏死临床表现很多的是少尿，血肌酐上涨，可出现因为急性尿毒症所出现的一些并发症，比如因为少尿以后水肿（C对）。肾梗死主要的临床表现为腰痛及胸背痛，可以出现血尿、蛋白尿及乏力、恶心、呕吐等消化道症状，还可出现肝脏转氨酶升高（A错）。肾脓肿是肾实质的化脓性炎症，在肾实质内有脓肿的形成。临床表现如下：1.腰痛患侧腰部呈持续性的胀痛，比较剧烈，2.体格检查时，患侧肾区压痛、叩击痛明显，3.全身炎症反应综合征。比如寒战、高热、纳差、乏力等，严重者可以出现血压下降，心率增快等感染性休克的表现，4.影像学检查，比如彩超、CT等，可以发现肾脏的脓肿病变（B错）。快速进行性肾小球肾炎，又叫做新月体型肾炎，可见于任何年龄，该病可呈急性起病，多数病人在发热或上呼吸道感染后出现急性肾炎综合征，即水肿、尿少、血尿、蛋白尿、高血压等，发病时患者全身症状较重，如疲乏、无力、精神萎靡，体重下降，可伴发热、腹痛。病情发展很快，起病数天内即出现少尿及进行性肾功能衰（D错）。毛细血管内增生性肾小球肾炎，本质上是急性肾炎，急性肾炎患者大多数是先有一个上呼吸道链球菌感染的病史，有念球菌感染在上呼吸道作为诱因，而引起身体的免疫功能紊乱，紊乱的免疫功能刺激了肾小球的反应造成了患者弥漫性的毛细血管内细胞增生。患者主要的临床症状是血尿，甚至有的患者可以出现肉眼血尿，30%的患者会出现大量的蛋白尿达到肾病综合症的程度。患者还可能会出现尿量减少，有些尿量减少的患者可能会导致急性的肾功能衰竭，大量的水分积聚在体内，可能会引起患者胸闷气短的心衰的症状，引起患者肺水肿的症状（E错）。